某女，68岁。素患缺铁性贫血，常规口服硫酸亚铁片治疗。本次因失眠就诊，症见不寐，心悸易惊，多梦，健忘，神疲乏力；舌淡苔白，脉细弱。医师处方柏子养心丸（水蜜丸），口服，一次6g，一日2次。患者家中备有健脾生血片，欲加服，执业药师给予建议，正确的是
A. 健脾生血片健脾和胃、养血安神，病证相符，可以同用
B. 健脾生血片含叶酸，有利于贫血治疗，可以同用
C. 健脾生血片含硫酸亚铁，属于重复用药，不宜同用
D. 健脾生血片含维生素B₁₂有利于贫血治疗，可以同用
E. 健脾生血片慎用于缺铁性贫血患者，不宜同用

正确答案：C。健脾生血片含硫酸亚铁，属于重复用药，不宜同用

解析：本题考查的是含西药组分的中成药。某女，68岁。素患缺铁性贫血，常规口服硫酸亚铁片治疗。本次因失眠就诊，症见不寐，心悸易惊，多梦，健忘，神疲乏力；舌淡苔白，脉细弱。医师处方柏子养心丸（水蜜丸），口服，一次6g，一日2次。患者家中备有健脾生血片，欲加服，执业药师给予建议，正确的是健脾生血片含硫酸亚铁，属于重复用药，不宜同用（C对）。健脾生血片：【功效】健脾和胃，养血安神。用于脾胃虚弱及心脾两虚所致的血虚证，症见面色萎黄或白，食少纳呆，腹胀脘闷，大便不调，烦躁多汗，倦怠乏力，舌胖色淡，苔薄白，脉细弱；缺铁性贫血见上述证候者（E错）。含西药成分：硫酸亚铁（ABD错）。